大脑皮质的功能定位
A. 颞横回是听觉中枢
B. 角回是视觉中枢
C. 中央前回是感觉中枢
D. 额中回是说话中枢
E. 额下回是书写中枢

正确答案：A。颞横回是听觉中枢

解析：大脑皮质的功能定位中，颞横回（A对）为听觉中枢所在位置；角回（B错）为阅读中枢所在位置；中央前回（C错）为躯体运动中枢所在位置；额中回（D错）为书写中枢所在位置；额下回（E错）为运动性语言中枢所在位置。